风湿性心肌炎病变主要累及
A. 心肌细胞
B. 心肌间质结缔组织
C. 心肌间质的小血管
D. 心肌间质神经组织
E. 心肌间质的嗜银纤维

正确答案：B。心肌间质结缔组织

解析：风湿性心肌炎的病变主要累及心肌间质结缔组织（B对），而不是心肌细胞（A错）。累及心肌间质小血管（C错）的主要是免疫反应性心肌炎（P153）和弥漫性间质性心肌炎（P153）。